患者，女，45岁，6个月前因出现口吐白沫、意识丧失、二便失禁。在专科医生指导下进行抗癫痫药物治疗，症状控制良好。近3个月服用西味替丁，患者出现脱发、体重增加、肠道功能紊乱。该患者各地求医，服用各种药物，具体药物品种不详。围绕该病例，医师、药师、护士对抗癫痫药的安全用药和用药事项进行用药讨论。抗癫痫药患者的用药指导错误的是
A. 长期规律用药
B. 定期监测肝功能
C. 有条件的应测定药物血药浓度
D. 遵循多药联合治疗原则
E. 联用其它药物时，请先咨询医师或药师

正确答案：D。遵循多药联合治疗原则

解析：本题考查抗癫痫药的一般治疗原则。癫痫治疗应遵循单药治疗原则（D错，为本题正确答案）。抗癫痫药的一般治疗原则如下：（1）应根据发作类型和以前用药及疗效情况选择抗癫痫药物；（2）个体化给药；（3）在专科医生指导下进行药疗（E对）；（4）遵循单药治疗原则；（5）小剂量起始，滴定增量，长期规律用药（A对）；（6）有条件的应测定药物的血浆浓度（C对），定期监测肝功能（B对）。